患者咳唾时胸胁引痛，咳逆喘息不能平卧，右侧肋间饱满，舌苔白腻，脉沉弦。其诊断
A. 痰饮，脾阳虚弱
B. 悬饮，邪犯胸肺
C. 支饮，寒饮伏肺
D. 溢饮，水饮泛溢
E. 悬饮，饮停胸胁

正确答案：E。悬饮，饮停胸胁

解析：题中患者以咳唾时胸胁引痛，咳逆喘息不能平卧为主症，故诊断为痰饮之悬饮。肺气郁滞，气不布津，停而为饮；饮停气滞，脉络受阻，故咳唾时胸胁引痛；饮邪上迫肺气，则咳逆喘息不能平卧；饮在胸腔，故右侧肋间饱满；舌苔白腻，脉沉弦为水结于里之候。故诊断为饮停胸胁证（E对）。痰饮，脾阳虚弱证以心悸气短，食少，大便或溏，形体逐渐消瘦为特征（A错）。悬饮，邪犯胸肺以寒热往来，身热起伏，汗少，或发热不恶寒，有汗而热不解为特征（B错）。支饮，寒饮伏肺证以咳逆喘满不得卧，痰吐白沫量多，经久不愈，天冷受寒加重等为特征（C错）。溢饮，水饮泛溢可见身体疼痛而沉重，甚则肢体浮肿，当汗出而不汗出，或伴咳喘等症（D错）。